在相同条件下，其挠曲变形量与桥体长度的关系是
A. 与桥体长度无关系
B. 桥体长度的平方成反比
C. 桥体长度的平方成正比
D. 桥体长度的立方成反比
E. 桥体长度的立方成正比

正确答案：E。桥体长度的立方成正比

解析：桥体的金属层的厚度与长度：在相同条件下，桥体挠曲变形量与桥体厚度的立方成反比，与桥体长度的立方成正比。缺牙区近远中间隙大时，应加厚桥体金属层，抵抗桥体挠曲。掌握“固定桥的设计”知识点。